窝沟封闭临床效果评价的指标有
A. 封闭剂保留率
B. 封闭剂脱落率
C. 防龋有效率
D. 患者满意率
E. 龋齿发病率

正确答案：A。封闭剂保留率

解析：本题考查窝沟封闭的临床效果评价。窝沟封闭的临床效果评价，常采用封闭剂保留率（A对）和龋降低率两个指标。